治疗甲状腺功能亢进症气阴两虚证，应首选
A. 他巴唑与逍遥散合二陈汤
B. 他巴唑与天王补心丹
C. 碘与知柏地黄丸
D. 他巴唑与生脉散
E. 碘液与龙胆泻肝汤

正确答案：D。他巴唑与生脉散

解析：甲状腺功能亢进症气阴两虚证，治宜益气养阴，消瘿散结，首选益气生津，敛阴止汗的生脉散（D对）。逍遥散合二陈汤疏肝理气，化痰散结，为治疗甲状腺功能亢进症气滞痰凝证的代表方（A错）。天王补心丹为甲状腺功能亢进症阴虚火旺证代表方（B错）。知柏地黄丸功用滋阴降火，主治肝肾阴虚，虚火上炎证（C错）。龙胆泻肝汤清肝泻火，为甲状腺功能亢进症肝火旺盛证的代表方（E错）。